变异型心绞痛产生的病变机制为
A. 冠状动脉痉挛
B. 冠状动脉内完全闭塞性血栓形成
C. 冠状动脉粥样硬化狭窄≥75%
D. 冠状动脉斑块破裂不完全血栓形成
E. 冠状动脉粥样硬化狭窄＜25%

正确答案：A。冠状动脉痉挛

解析：变异型心绞痛由冠状动脉痉挛，血流进一步减少导致的（A对BD错）；变异型心绞痛在冠脉造影时，出现血管（“正常冠脉”或粥样硬化性狭窄部位）一过性狭窄或闭塞，应用扩冠药物后狭窄或闭塞能够很快消失，或自行消失，同时能够除外导管局部刺激，表明冠状动脉主支无明显病变（CE错）。